因左旋体引起不良反应，所以右旋体上市，具有短效催眠作用的药物是
A. 氟西汀
B. 艾司佐匹克隆
C. 艾司唑仑
D. 齐拉西酮
E. 美沙酮

正确答案：B。艾司佐匹克隆

解析：本题考查非苯二氮䓬类药物。因左旋体引起不良反应，所以右旋体上市，具有短效催眠作用的药物是艾司佐匹克隆（B对）。佐匹克隆结构中含有一个手性中心，右旋异构体为艾司佐匹克隆，具有很好的短效催眠作用，而左旋体无活性且易引起毒副作用；氟西汀（A错）为非三环类的抗抑郁药，临床上常用其盐酸盐，S异构体的活性较强，临床使用外消旋体；艾司唑仑（C错）、齐拉西酮（D错）分子中不含有手性碳；美沙酮（E错）为镇痛药，有左旋体及右旋体。左旋体较右旋体效力强8～50倍。常用其消旋体。